安乐死的本意是
A. 他人干预死亡
B. 无痛苦死亡
C. 自然死亡
D. 自己结束生命
E. 脑死亡

正确答案：B。无痛苦死亡

解析：安乐死所表达的是一种无痛苦的、有尊严的死亡状态，是人类理想的死亡状态（B对AD错）。自然死亡是由于没有外力因素造成的。是由于人体在生长发育过程中，逐渐出现的器官衰老功能减弱，直至衰竭引起的死亡（C错）。脑死亡，即指原发于脑组织严重外伤或原发性疾病，导致包括脑干在内的全脑功能不可逆转的丧失，是整个中枢神经系统的全部死亡（E错）。